轻度子痫前期初产妇，孕39周，临产，宫口开全1小时，LOA,S+3，胎心110次/分，羊水轻度胎粪污染。此时应采取的措施
A. 人工破膜
B. 剖宫产
C. 引产
D. 会阴侧切
E. 低位产钳术

正确答案：E。低位产钳术

解析：轻度子痫前期初产妇，孕39周，临产，宫口开全1小时，LOA（左枕前位），S+3，胎心110次/分（正常值为110～160次/分），羊水轻度胎粪污染，因为此患者是子痫前期且伴有轻度胎粪污染，应加快产程进程，所以此时应采取的措施是低位产钳术（E对），适用于胎儿胎头的颅骨最低点低于坐骨棘2cm以上，该术式能够协助胎儿快速脱离母体，风险低，对母亲和胎儿的损伤较小。